三七的功效是
A. 收敛止血
B. 凉血止血
C. 温经止血
D. 理气止血
E. 化瘀止血

正确答案：E。化瘀止血

解析：本题考查三七的功效。三七的功效是化瘀止血（E对）。三七【功效】化瘀止血，活血定痛。白及【功效】收敛止血（A错），消肿生肌。马齿苋【功效】清热解毒，凉血止血（B错），通淋。艾叶【功效】温经止血（C错），散寒止痛。